根据《医疗用毒性药品管理办法》，执业医师开具处方中含有毒性中药川乌，执业药师调配处方时
A. 每次处方剂量不得超过三日极量
B. 应当给付川乌的炮制品
C. 应当给付生川乌
D. 应当拒绝调配
E. 取药后处方保存一年备查

正确答案：B。应当给付川乌的炮制品

解析：本题考查医疗用毒性药品使用和调配要求。根据《医疗用毒性药品管理办法》，执业医师开具处方中含有毒性中药川乌，执业药师调配处方时应当给付川乌的炮制品（B对）。《医疗用毒性药品管理办法》第九条：医疗单位供应和调配毒性药品，凭医生签名的正式处方。国营药店供应和调配毒性药品，凭盖有医生所在的医疗单位公章的正式处方。每次处方剂量不得超过二日极量（A错）。调配处方时，必须认真负责，计量准确，按医嘱注明要求，并由配方人员及具有药师以上技术职称的复核人员签名盖章后方可发出。对处方未注明“生用”的毒性中药，应当付炮制品（C错）。如发现处方有疑问时，须经原处方医生重新审定后再行调配。处方一次有效，取药后处方保存二年备查（E错）。